静脉麻醉，应首选
A. 普鲁卡因
B. 乙醚
C. 利多卡因
D. 硫喷妥钠
E. 丁哌卡因

正确答案：D。硫喷妥钠

解析：硫喷妥钠是通过静脉注入体内，作用于中枢神经系统而产生全麻状态的药物，称为静脉麻醉药。适用于全麻诱导，具有舒适快速的特点。小儿基础麻醉。短小浅表手术，如脓肿切开、脱臼复位等。辅助其他麻醉。控制痉挛、惊厥（D对）。普鲁卡因（A错）、利多卡因（C错）为局部麻醉常用药。乙醚（B错）为吸入麻醉药。丁哌卡因（E错）为长效局部麻醉药。